某男性炉前工，在一个无通风设备条件的环境中连续工作4小时，出现剧烈的头痛、头昏、四肢无力，有轻度的意识障碍，但无昏迷。引起该患者出现上述表现的毒物最可能是
A. H₂S
B. NO₂
C. CS₂
D. CO
E. CO₂

正确答案：D。CO